患者为壮年男性，因胃十二指肠溃疡急性穿孔合并腹膜炎入院。症见：上腹部持续性剧痛，腹胀，拒按，伴发热恶寒，恶心呕吐，大便干结，小便黄赤，舌红苔黄，脉洪数。其证型是
A. 肝气郁结
B. 脾胃不和
C. 气血阻闭
D. 胃肠实热
E. 热伤气阴

正确答案：D。胃肠实热

解析：患者上腹部拒按，伴恶心呕吐诊断为胃十二指肠溃疡急性穿孔合并腹膜炎，发热恶寒，恶心呕吐，大便干结，小便黄赤，舌红苔黄，脉洪数诊断为胃肠实热证（D对）。肝气郁结临床表现多见胁痛，胸闷，脘胀，嗳气，妇女月经不调等症（A错）。脾胃不和表现为脘腹痞胀，或胃脘嘈杂，食少纳呆，或食后腹胀，嗳气肠鸣，大便不调，脉弦（B错）。气血阻闭证表现为大便干结，小便短少，舌苔薄白，脉弦细数（C错）。热伤气阴表现为面色淡白无华或萎黄，口唇、爪甲色淡，头晕目眩，或心悸，失眠，多梦，或手足拘挛麻木，或妇女月经量少色淡，或月经后期，或经闭。舌淡苔白，脉细（E错）。